关于糖皮质激素在类风湿关节炎（RA）治疗中用药原则，说法错误的是
A. 应尽可能短期使用
B. 用于有多器官系统受累的重症患者
C. 可单独用于RA的治疗
D. 非甾体抗炎药疗效不佳时，可联合使用糖皮质激素
E. 小剂量使用即可缓解多数患者的症状

正确答案：C。可单独用于RA的治疗

解析：本题考查类风湿关节炎的药物治疗。激素治疗RA的原则是尽可能小剂量、短期使用（A对），不推荐单用或长期大最使用糖皮质激素（C错，为本题正确答案）；并在治疗过程中须注意补充钙剂和维生素D以防止骨质疏松，还应监测血压及血糖变化。糖皮质激素能迅速减轻关节疼痛、肿胀，在关节炎急性发作或伴有心、肺、眼和神经系统等器官受累的重症患者（B对），可给予短效激素，其剂量依据病清严重程度而调整。小剂量糖皮质激素（每日泼尼松10mg或等效的其他激素）可缓解多数患者的症状（E对），并作为DMARDs起效前的“桥梁”作用，或NSAIDs疗效不满意时的短期干预措施（D对），必须纠正单用激素治疗RA的倾向，使用激素时应同时服用DMARDs。